下列疾病，脑脊液放置24小时后，可有纤细的网状薄膜形成的是
A. 化脓性脑膜炎
B. 病毒性脑膜炎
C. 结核性脑膜炎
D. 脑脓肿
E. 脑肿瘤

正确答案：C。结核性脑膜炎

解析：正常脑脊液不含有纤维蛋白原，放置24小时后不会形成薄膜及凝块。结核性脑膜炎（C对）的脑脊液静置12～24小时后，可见液面有纤细的薄膜形成，取此膜涂片检查结核杆菌阳性率极高。急性化脓性脑膜炎（A错）、脑脓肿（D错）时，脑脊液静置1～2小时即可出现凝块或沉淀物；脑肿瘤（E错）引起蛛网膜下腔阻塞时，由于阻塞，远端脑脊液蛋白质含量常高达15g/L，使脑脊液呈黄色胶冻状。病毒性脑膜炎（B错）患者脑脊液清亮透明。